细菌性阴道病诊断标准不包括
A. 匀质稀薄白带
B. 阴道pH＞4.5
C. 氨臭味试验阳性
D. 线索细胞阳性
E. 挖空细胞阳性

正确答案：E。挖空细胞阳性

解析：以下四项中有三项阳性，即可临床诊断为细菌性阴道病。1 、匀质稀薄的白带（A对），常黏附于阴道壁；2 、线索细胞阳性（D对）；3、 阴道分泌物pH＞4.5（B对）；4 、胺臭味实验阳性（C对）。挖空细胞（P104）（E错，为本题正确答案）多见于尖锐湿疣。